男，35岁，排尿烧灼样疼痛伴尿频3日，尿道口大量分泌物，晨起尿道口有脓痂。有不洁性生活史。查体：尿道外口有大量脓性分泌物，龟头和阴茎红肿。该病原菌是
A. 阴道毛滴虫
B. 淋病奈瑟氏菌
C. 白假丝酵母
D. 梅毒螺旋体
E. 人类支原体

正确答案：B。淋病奈瑟氏菌

解析：白假丝酵母为机会致病菌通常存在于人的皮肤、口腔、上呼吸道、阴道及肠道黏膜，当机体出现菌群失调或抵抗力下降时（如AIDS），可引起各种假丝酵母病。1.皮肤、黏膜感染：皮肤白假丝酵母感染好发于皮肤潮湿、皱褶部位，可引起湿疹样皮肤白假丝酵母病、肛门周围瘙痒症及肛门周围湿疹和指间糜烂症等，易与湿疹混淆。黏膜感染则有鹅口疮、口角糜烂、外阴与阴道炎等。其中以鹅口疮最为多见。2.内脏感染 包括肺炎、支气管炎、肠炎、膀胱炎及肾盂肾炎等，偶尔也可引起败血症。3.中枢神经系统感染可有脑膜炎、脑膜脑炎及脑脓肿等原发病灶转移而来（C错）。梅毒螺旋体仅感染人类引起，梅毒病人是唯一的传染源。梅毒一般分为后天性（获得性）和先天性两种，前者通过性接触传染，故又称为性病梅毒，后者从母体通过胎盘传染给胎儿。输入梅毒螺旋体污染的液或血制品，可引起输血后梅毒（D错）。人类支原体可引起附睾炎、盆腔炎、产褥热、慢性羊膜炎，新儿肺炎、脑炎、脑脓肿（E错）。阴道毛滴虫是寄生在人体阴道和泌尿生殖道的毛鞭虫，由其引起的滴虫性阴道炎、尿道炎或前列腺炎，是以性传播为主的一种传染病（A错）。